影响有毒无毒的因素有
A. 品种来源
B. 采集时间
C. 炮制加工
D. 给药途径
E. 制剂工艺

正确答案：A、B、C、D、E。品种来源；采集时间；炮制加工；给药途径；制剂工艺

解析：本题考查影响有毒无毒的因素。影响有毒无毒的因素有品种来源（A对）、采集时间（B对）、炮制加工（C对）、给药途径（D对）、制剂工艺（E对）。影响有毒无毒的因素：药物的有毒与无毒受到多种因素影响。主要有品种、来源、入药部位、产地、采集时间、贮存、加工炮制、剂型、制剂工艺、配伍、给药途径、用量、用药次数与时间长短、皮肤与黏膜的状况、施用面积的大小、病人的体质、年龄、性别、种属、证候性质，以及环境污染等。